舌下给药吸收迅速、起效最快，作为心绞痛急性发作首选的治疗药物是
A. 硝酸甘油
B. 硝酸异山梨酯
C. 单硝酸异山梨酯
D. 美托洛尔
E. 卡托普利

正确答案：A。硝酸甘油

解析：本题考查硝酸甘油。舌下给药吸收迅速、起效最快，作为心绞痛急性发作首选的治疗药物是硝酸甘油（A对）。硝酸甘油舌下含服吸收迅速完全，生物利用度可达80%。硝酸异山梨酯（B错）作用持续时间2～6小时，比硝酸甘油长，属于中效药。单硝酸异山梨酯（C错）临床用于冠心病的长期治疗，心绞痛的预防，心肌梗死后持续心绞痛的治疗，与洋地黄、利尿剂联合治疗慢性心功能衰竭。美托洛尔（D错）主要用于室上性和室性心律失常。卡托普利（E错）是血管紧张素转换酶抑制剂，能够扩张血管、降低血压，发挥治疗高血压的作用。